伴放线放线杆菌的致病作用包括
A. 产生白细胞毒素
B. 抑制中性粒细胞的趋化能力
C. 产生内毒素和胶原酶
D. 产生成纤维细胞抑制因子
E. 以上都是

正确答案：E。以上都是

解析：本题考查伴放线放线杆菌的致病作用。伴放线放线杆菌即伴放线聚集杆菌，伴放线放线杆菌的致病作用：它可产生许多毒性因子，如白细胞毒素（A对）、内毒素和胶原酶（C对）等。它能产生中性粒细胞的趋化抑制因子（B对）来降低宿主抵抗力；它还能产生成纤维细胞抑制因子（D对）抑制牙周组织内成纤维细胞合成胶原。（ABCD均对，故E为本题的正确答案）。